可使舌缩短的肌肉是
A. 舌上纵肌和舌下纵肌
B. 舌横肌
C. 舌垂直肌
D. 颏舌肌
E. 舌骨舌肌

正确答案：A。舌上纵肌和舌下纵肌

解析：舌肌为横纹肌，构成舌的主体，分为舌内肌和舌外肌两部分。舌内肌的舌上纵肌和舌下纵肌收缩时使舌缩短。掌握“表情肌、舌腭肌”知识点。